精神卫生工作中最主要的任务是
A. 维护和促进心理健康
B. 预防各种心理障碍、心理疾病
C. 矫治各种心理障碍、心理疾病
D. 培养健全人格
E. 提高人类对社会生活的适应能力

正确答案：B。预防各种心理障碍、心理疾病